婴儿期计划免疫，下列哪项措施不正确
A. 8个月注射麻疹疫苗
B. 2～3个月接种卡介苗
C. 6个月结合季节，注射乙脑疫苗
D. 3个月接种百、白、破三联疫苗
E. 2个月开始服脊灰减毒活疫苗糖丸

正确答案：B。2～3个月接种卡介苗

解析：本题考查婴儿期计划免疫。婴儿应在出生时就接种卡介苗（B错，为本题正确答案）；2个月开始服脊灰减毒活疫苗糖丸（E对）；3个月接种百、白、破三联疫苗（D对）；6个月结合季节，注射乙脑疫苗（C对）；8个月注射麻疹疫苗（A对）。